男婴，9个月，腹泻10天，大便3～4次每天，呈蛋花样，无腥臭，婴儿食欲好，精神好，最可能诊断是
A. 轮状病毒肠炎
B. 产毒性大肠杆菌肠炎
C. 生理性腹泻
D. 侵袭性大肠杆菌肠炎
E. 真菌性肠炎

正确答案：A。轮状病毒肠炎

解析：患者男婴，9个月，腹泻10天，大便3～4次每天，呈蛋花样，无腥臭（轮状病毒肠炎的表现），婴儿食欲好，精神好，结合患者的表现，最可能诊断是轮状病毒肠炎（A对）。生理性腹泻、真菌性肠病、产毒性和侵袭性大肠杆菌肠炎的腹泻特点与轮状病毒肠炎的腹泻特点不同。